在影响毒物对机体作用的因素中，哪一种状况和条件是错误的
A. 接触毒性大的毒物，就一定会中毒
B. 挥发性毒物，吸入中毒危险大
C. 接触一定剂量的毒物，可能会中毒
D. 毒物浓度与作用时间是中毒的必需条件
E. 个体感受性是中毒难易的重要条件

正确答案：A。接触毒性大的毒物，就一定会中毒